清蛋白产生的胶体渗透压占血浆胶体总渗透压的
A. 55%～60%
B. 60%～65%
C. 65%～70%
D. 70%～75%
E. 75%～80%

正确答案：E。75%～80%